某厂生产的一批啤酒中检出一种有毒化学物质，经动物实验证实可通过呼吸道吸入、消化道摄入、皮下或肌肉注射、皮肤接触诱发肿瘤，致癌的主要靶器官是胃，该化合物可能是
A. 黄曲霉毒素
B. N-亚硝基化合物
C. 杂环胺
D. 甲醛
E. 亚硝酸盐

正确答案：B。N-亚硝基化合物